下列不符合《女职工劳动保护特别规定》的是
A. 对怀孕7个月以上的女职工，用人单位可以适当延长劳动时间
B. 怀孕满4个月流产的，享受42天产假
C. 女职工生育享受98天产假
D. 怀孕女职工在劳动时间内进行产前检查，所需时间计入劳动时间
E. 生育多胞胎的，每多生育1个婴儿，增加产假15天

正确答案：A。对怀孕7个月以上的女职工，用人单位可以适当延长劳动时间

解析：本题考查《女职工劳动保护特别规定》的相关内容。《女职工劳动保护特别规定》第六条规定：对怀孕7个月以上的女职工，用人单位不得延长劳动时间或者安排夜班劳动，并应当在劳动时间内安排一定的休息时间（A错，为本题正确答案）。《女职工劳动保护特别规定》中：怀孕满4个月流产的，享受42天产假（B对）；女职工生育享受98天产假（C对）；怀孕女职工在劳动时间内进行产前检查，所需时间计入劳动时间（D对）；生育多胞胎的，每多生育1个婴儿，增加产假15天（E对）。